分子中含有螺环基团，提高与受体结合能力，半衰期较长的药物是
A. 替米沙坦
B. 氯沙坦
C. 依普罗沙坦
D. 厄贝沙坦
E. 缬沙坦

正确答案：D。厄贝沙坦

解析：本题考查AⅡ受体阻断药。厄贝沙坦（D对）为常用的血管紧张素Ⅱ受体阻断剂，为螺环化合物，缺少氯沙坦结构中的羟甲基，但与受体结合的亲和力却是氯沙坦的10倍。